“循喉咙之后，上入颃颡”的经脉是
A. 足厥阴肝经
B. 足少阴肾经
C. 足少阳胆经
D. 足太阴脾经
E. 足阳明胃经

正确答案：A。足厥阴肝经

解析：该题考查足厥阴肝经的循行。足厥阴肝经起于足大趾外侧，经足背、内踝前（在内踝上8寸出与足太阴相交而循行于其后侧）上行于大腿内侧，联系阴部，入体腔，联系于胃、肝、胆、膈、胸胁，经咽喉上联目系，上行出于额部，与督脉交会于颠顶部。目系支脉下经颊里，环绕唇内。肝部支脉上膈，注于肺中（A对BCDE错）。